某患者因腮腺良性肿瘤，将于明日行腮腺浅叶切除术加面神经解剖术。今日术前家属签字时，谈话中以下哪项是不必要的
A. 术后可能出现面瘫
B. 耳垂麻木
C. 涎瘘
D. Frey综合征
E. 可能出现半侧下颌骨麻木

正确答案：E。可能出现半侧下颌骨麻木

解析：本题考查腮腺手术可能出现的问题。下颌骨的感觉由下牙槽神经支配，下牙槽神经不在腮腺术区，行腮腺浅叶切除术及面神经解剖术时一般不会触及（E错，为本题的正确答案）。行腮腺浅叶切除术加面神经解剖术，如损伤面神经，术后可能出现面瘫（A对）。耳大神经向后分布于耳垂、耳廓等处，手术时，若不注意保护耳大神经的耳垂支，可能出现术后耳垂麻木（B对）。手术损伤腮腺或其导管也可导致涎瘘的发生（C对）。手术时若切断耳颞神经中的副交感分泌神经支与支配皮肤汗腺、表浅血管的交感神经支错位愈合可能会导致Frey综合征（D对）。